短效苯二氮䓬类药物是
A. 三唑仑
B. 艾司唑仑
C. 地西泮
D. 劳拉西泮
E. 硝西泮

正确答案：A。三唑仑

解析：常用苯二氮䓬类药物分类及作用特点-短效类：三唑仑（A对）、奥沙西泮。